炒王不留行的火候应选用
A. 中火
B. 大火
C. 小火
D. 武火
E. 文火

正确答案：A。中火

解析：本题考查的是王不留行的炮制方法。炒王不留行的火候应选用中火（A对）。王不留行：【炮制方法】处方用名有王不留行、王不留、留行子、炒王不留行、炒王不留。①王不留行：取原药材，除去杂质。②炒王不留行：取净王不留行，投入预热容器内，中火拌炒至大部分爆花即可。火力是指药物炮制过程中所用热源释放出的热量大小、火的强弱或温度的高低。火力可分为文火（E错）、中火、武火（D错）。文火即小火（C错），武火即大火（B错）或强火，介于文火和武火之间的是中火。先文火后武火，或文火和武火交替使用的为文武火。